牙齿形态异常不包括
A. 畸形中央尖
B. 融合牙
C. 氟斑牙
D. 过小牙
E. 弯曲牙

正确答案：C。氟斑牙

解析：本题考查牙齿形态异常。氟牙症（C错，为本题的正确答案）属于牙齿结构异常。牙齿发育异常是指牙齿数目异常、牙齿形态异常、牙齿结构异常、牙齿萌出于脱落异常。畸形中央尖（A对）、融合牙（B对）、过小牙（D对）和弯曲牙（E对）均属于牙齿形态异常。